可作为寒性哮喘辨证依据的是
A. 痰稠色黄，舌红苔黄
B. 面色苍白，脉细无力
C. 面色白，腰膝痠软
D. 食少便溏，舌淡脉缓
E. 痰稀色白，舌苔白腻

正确答案：E。痰稀色白，舌苔白腻

解析：寒性哮喘辨证依据是哮证表现和寒象，呼吸气急，喉中哮鸣有声，为哮证的典型表现；口不渴或渴喜热饮，痰稀色白，舌苔白腻，弦紧或浮紧，为寒邪内扰之征（E对）。痰稠色黄，舌红苔黄见于热可见于性哮喘（A错）。面色苍白，脉细无力可见于哮喘缓解期肾虚证（B错）。面色白，腰膝痠软也可见于哮喘缓解期肾虚证（C错）。食少便溏，舌淡脉缓见于哮喘缓解期脾虚证（D错）。